目前诊断精神分裂症主要依靠的手段是
A. 临床观察
B. 心理学测验
C. 遗传学检查
D. 脑电图检查
E. 脑影像学检查

正确答案：A。临床观察

解析：精神分裂症的诊断依据临床特点，即建立在临床观察（A对）和描述性精神病理学的基础上。